光学异构体活性不同的镇痛药物有
A. 盐酸吗啡
B. 盐酸哌替啶
C. 盐酸美沙酮
D. 盐酸布桂嗪
E. 苯噻啶

正确答案：A、C。盐酸吗啡；盐酸美沙酮

解析：本题考查镇痛药。光学异构体活性不同的镇痛药物有盐酸吗啡（A对）、盐酸美沙酮（C对）。吗啡是由5个环（A、B、C、D、E）稠合而成的复杂结构，具有5个手性中心，其有效的吗啡构型是左旋吗啡，而右旋吗啡则完全没有镇痛活性；美沙酮为阿片受体激动剂，镇痛效果比吗啡、哌替啶强，其左旋体镇痛作用比右旋体强20倍。临床上主要用于海洛因成瘾的戒毒治疗。盐酸哌替啶（B错）、盐酸布桂嗪（D错）、苯噻啶（E错）中均不含有手性碳原子，无光学异构体。